可抑制细菌DNA依赖性RNA多聚酶的是
A. 磷霉素
B. 替考拉宁
C. 利福平
D. 舒巴坦
E. 左氧氟沙星

正确答案：C。利福平

解析：本题考查利福平。利福平（C对）的抗菌作用机制是特异性抑制敏感微生物的DNA依赖性RNA多聚酶，阻碍其mRNA的合成，而对人细胞的则无影响。β-内酰胺酶抑制剂的代表药物为克拉维酸、舒巴坦（D错）、他唑巴坦。其可与头孢菌素类药组成复方制剂使用。左氧氟沙星（E错）为氟喹诺酮类抗菌药物，其主要作用靶位在细菌的DNA拓扑异构酶，这是一种部分异构酶，共有4个亚单位，干扰DNA复制、转录和重组，从而影响DNA的合成而致细菌死亡。磷霉素（A错）抑制细菌细胞壁的早期合成，其分子结构与磷酸烯醇丙酮酸相似，故可竞争同一转移酶，使细菌细胞壁的合成受到抑制而导致细菌死亡。替考拉宁（B错）抑制细胞璧合成的途径与万古霉素一样，干扰肽聚糖中新的部分的合成过程。